下列哪种刷牙方法对清除龈沟附近和邻间隙的菌斑效果最好
A. 轻刷法
B. 水平颤动法
C. 竖转动法
D. 重刷法
E. 横刷法

正确答案：B。水平颤动法

解析：本题考查刷牙方法。水平颤动法（B对）亦称Bass法，刷牙时将刷头放于牙颈部，毛束与牙面呈45°角，毛端向着根尖方向，轻轻加压，使毛束末端一部分进入龈沟，一部分在沟外并进入邻面。所以该刷牙方法对清除龈沟附近和邻间隙的菌斑效果最好。轻刷法（A错）力度不够，不能使刷毛伸入龈沟附近和邻间隙，故也不能有效清除龈沟附近和邻间隙的菌斑。竖转动法（C错）刷毛不进入龈沟，对清除龈沟附近和邻间隙的菌斑效果不好。重刷法（D错）和横刷法（E错）着重清理龈缘以上菌斑，对清除龈沟附近和邻间隙的菌斑效果不好。